除另有规定外，在启用后最多可使用4周的制剂是
A. 酊剂
B. 糖浆剂
C. 涂膜剂
D. 合剂
E. 煎剂

正确答案：C。涂膜剂

解析：本题考查的是涂膜剂的质量要求。除另有规定外，在启用后最多可使用4周的制剂是涂膜剂（C对）。涂膜剂系指原料药物溶解或分散于含成膜材料的溶剂中，涂搽患处后形成薄膜的外用液体制剂。除另有规定外，应避光、密闭储存，涂膜剂在启用后最多可使用4周。酊剂（A错）：系指原料药物用规定浓度的乙醇提取或溶解而制成的澄清液体制剂，也可用流浸膏稀释制成。酊剂应置遮光容器内密封，置阴凉处贮存。糖浆剂（B错）：系指含有原料药物的浓蔗糖水溶液。糖浆剂应密封，避光置干燥处贮存。合剂（D错）：系指中药饮片用水或其他溶剂，采用适宜的方法提取、制成的口服液体制剂，其中单剂量灌装者也可称为口服液。除另有规定外，合剂应密封，置阴凉处贮存。煎剂（E错）指汤剂。汤剂是将中药饮片或粗粒加水煎煮或沸水浸泡、去渣取汁而成的液体制剂。汤剂临用时制备，味苦量大，服用不便，不宜久置。